慢性菌痢的病程应该超过的时间是
A. 1个月
B. 2个月
C. 3个月
D. 半年
E. 1年

正确答案：B。2个月